医德教育的目的是
A. 提高医德认识
B. 培养医德情感
C. 锻炼医德意志
D. 树立医德信念
E. 养成良好的医德习惯

正确答案：E。养成良好的医德习惯

解析：医德教育的目的是通过系统和普及性的教育，对教育对象的品格进行塑造，逐渐将社会主义医德理论和规范转化为个人内在的医德信念，自觉养成良好的医德品质和行为习惯（E对）。医学道德认知是指医务人员对客观存在的医学道德理论、原则、规范的认识与理解。认知是行为的先导（A错）。医学道德情感是指医务人员对医学道德的情感体验，分正负两性和无动于衷三类（B错）。道德行为是指个体表现出符合道德的行为。医学道德行为，是医务人员面临患者疾病治疗时，从多种可行的处置模式中经过意志的判断与选择，自觉克服困难、排除障碍，做出有利于患者决策的心理过程及其结果。可见，医学道德行为修养即包括内在的意志活动，又包括意志活动推动的行为表现（C错）。通过修养过程医务人员能够使得行医行为始终吻合医学职业精神的要求。所以在医德品质诸要素中，居于主导和核心地位的是医德信念（D错）。